采用中国药典规定的方法与装置，现在盐酸溶液（9→1000）中检查2小时，每片不得有裂缝、崩解等，取出，在pH6.8的磷酸盐缓冲液中检查，应在1小时内全部崩解的是
A. 肠溶片
B. 泡腾片
C. 可溶片
D. 舌下片
E. 薄膜衣片

正确答案：A。肠溶片

解析：本题考查片剂的崩解度。采用中国药典规定的方法与装置，肠溶衣片（A对）在盐酸溶液（9→1000）中2小时不得有裂缝、崩解、软化等，在pH6.8的磷酸盐缓冲液中1小时内全部崩解并通过筛网；可溶片（C错）崩解时限为3分钟；舌下片（D错）和泡腾片（B错）崩解时限为5分钟；薄膜衣片（E错）崩解时限为30分钟。